女，38岁。四肢无力，双下肢浮肿及皮下出血点2月，查尿蛋白++，红细胞++，ANA（+），有光过敏，最大的可能诊断是
A. 多发性肌炎
B. 系统性红斑狼疮
C. 急性肾小球肾炎
D. 慢性肾小球肾炎
E. 过敏性紫癜

正确答案：B。系统性红斑狼疮

解析：育龄期女性患者（系统性红斑狼疮好发人群），光过敏（对日光有明显反应，引起皮疹，是SLE的常见非特异性皮疹）、皮下出血点（血液系统改变）、四肢无力、肾功能异常（尿蛋白++，红细胞++，双下肢浮肿）及ANA阳性（抗核抗体，见于几乎所有的SLE患者，但特异性低），符合系统性红斑狼疮诊断标准（B对）。多发性肌炎（A错）以对称性四肢近端无力为主要表现，肾脏较少受累，无光过敏及皮下出血点。急、慢性肾小球肾炎（CD错）均无光过敏、ANA（抗核抗体）阳性等表现。过敏性紫癜（E错）多于发病1～3周前有上呼吸道感染前驱症状，皮肤紫癜多局限于四肢，经7～14日可逐渐消退，一般无光过敏表现，且ANA阴性。